火器伤防止感染最好的方法是
A. 充分显露伤道
B. 伤口引流
C. 清洗，消毒
D. 简单包扎
E. 早期彻底清创

正确答案：E。早期彻底清创

解析：早期彻底清创是防止感染的最好方法。同时还应尽早给予抗生素和破伤风抗毒素。掌握“火器伤、热烧伤”知识点。